后牙3/4冠与前牙3/4冠邻沟的主要不同之处是
A. 邻沟的作用
B. 邻沟的方向
C. 邻沟的深度
D. 邻沟的形态
E. 邻沟的位置

正确答案：B。邻沟的方向

解析：后牙3/4冠与前牙3/4冠邻沟的主要不同之处是邻沟的方向不同，前牙邻沟方向与牙冠唇面切2/3平行，后牙邻沟方向应与轴壁平行。掌握“部分冠”知识点。